下列各项，不属于缺铁性贫血诊断依据的是
A. 血清铁浓度降低
B. 血清铁蛋白降低
C. 小细胞低色素性贫血
D. 总铁结合力降低
E. 转铁蛋白饱和度＜15%

正确答案：D。总铁结合力降低

解析：缺铁性贫血时总铁结合力是升高的（D错，为本题正确答案）。